关于癌症疼痛患者止痛药使用原则的说法，错误的是
A. 按阶梯给药
B. 提倡无创给药方式
C. 疼痛时用药，不痛时不需用药
D. 应个体化用药
E. 注意预防药物的不良反应

正确答案：C。疼痛时用药，不痛时不需用药

解析：本题考查癌痛患者的镇痛药使用原则。疼痛控制的总体原则：①按时给药，不是按需给药（C错，为本题正确答案）。②按阶梯给药（A对）。③能口服给药尽量口服给药，提倡无创的给药方式（B对）。④用药个体化（D对）。⑤注意具体细节，如注意不良反应处理（E对）。